小儿暑温的好发月份是
A. 5~7月
B. 6~8月
C. 7~9月
D. 8~10月
E. 9~11月

正确答案：C。7~9月

解析：小儿暑温为感受暑温邪毒所引起，好发于7-9月（C对）。5~7月常发为温病中的春温的好发季节（A错）。6~8月常发为温病中的湿温的好发季节（B错）。8~10月常发为温病中的伏暑的好发季节（D错）。9~11月常发为温病中的秋燥的好发季节（E错）。